β受体阻断剂是
A. 六烃季铵
B. 十烃季铵
C. 筒箭毒碱
D. 酚妥拉明
E. 普萘洛尔

正确答案：E。普萘洛尔